病变位于上颌左右中切牙牙根之间，多呈心形
A. 含牙囊肿
B. 残余囊肿
C. 正中囊肿
D. 球上颌囊肿
E. 鼻腭管囊肿

正确答案：E。鼻腭管囊肿

解析：本题考查鼻腭管囊肿。病变位于上颌左右中切牙牙根之间，多呈心形为鼻腭管囊肿（E对）。鼻腭管囊肿：病变位于上颌左右中切牙牙根之间或后方，多呈心形或圆形低密度改变，中切牙牙根可被推移位，但牙周膜和骨硬板连续。